患者，男，52岁。间歇性右上腹痛2个月，实验室检查：甲胎蛋白320μg/L，为了确诊，应该做的检查是
A. 肝功能试验
B. 癌胚抗原
C. B超
D. 腹腔镜
E. 血小板计数

正确答案：C。B超

解析：患者间歇性右上腹痛2个月，甲胎蛋白持续4周在200㎍/L以上，应警惕肝癌的可能。为了明确诊断，应做B超（C对）排查，超声检测可显示直径为2CM以上的肿瘤，对早期定位诊断有较大价值。彩色多普勒血液成像可分析测量肿瘤的血流，根据病灶的血供情况，有助于辨别病变的良恶性质。癌胚抗原（B错）对本病的诊断与预后有一定价值。腹腔镜（D错）创口较大，不作为首选。肝功能试验（A错）、血小板计数（E错）均不可作为确诊检查。